对布鲁氏杆菌叙述错误的是
A. 是波浪热的病原体
B. 分6个生物种，我国流行羊、牛、猪3种
C. 为革兰阳性小杆菌
D. 重要抗原是M抗原和A抗原
E. 主要通过接触经呼吸道皮肤等途径传播

正确答案：C。为革兰阳性小杆菌